男34岁，建筑工人，一次事故严重外伤，大量出血，血压下降少尿，经抢救低血压和血容量已纠正后，尿量仍很少，为避免肾功衰竭的进展，应给哪种药物：
A. 氢氯噻嗪
B. 呋塞米
C. 螺内酯
D. 氨苯蝶啶
E. 卡托普利

正确答案：B。呋塞米

解析：为避免肾功衰竭的进展，应给呋塞米（B对），呋塞米可以扩张肾血管，增加肾血流量和肾小球滤过率，对肾衰竭有一定好处。螺内酯（C错）、氨苯蝶啶（D错）肾功能不全者禁用。氢氯噻嗪（A错）吸收缓慢，作用时间较长，对肾衰竭并无明显帮助。卡托普利（E错）主要用于降压，且肾功能不全者禁用。